可以引起牙齿黄染的药物是
A. 加替沙星
B. 庆大霉素
C. 甲砜霉素
D. 多西环素
E. 林可霉素

正确答案：D。多西环素

解析：本题考查药物的不良反应。多西环素（D对）属于四环素类，可与钙离子形成的螯合物沉积于牙齿和骨中，造成牙齿黄染。可以引起跟腱断裂，加替沙星（A错）引起血糖异常。庆大霉素（B错）不良反应是耳毒性，血压下降。甲砜霉素（C错）未见有再生障碍性贫血。林可霉素（E错）大剂量静脉快速滴注可引起血压下降、心电图变化，甚至心跳、呼吸停止。